根据《药品经营质量管理规范现场检查指导原则》，检查项目分为三级，其中严重缺陷项目（备注为**）为药品经营企业绝对禁止违反的项目。下列检查项目中，不属于药品批发企业严重缺陷项目的是
A. 经营条件与经营范围规模不相适应
B. 发票内容与付款流向不一致
C. 药品追溯管理与实施过程中，购进药品未索取发票
D. 未遵循诚实守信、依法经营

正确答案：A。经营条件与经营范围规模不相适应

解析：本题考查的是药品批发企业的严重缺陷项目。经营条件与经营范围规模不相适应属于药品零售企业的严重缺陷项目（A错，为本题正确答案）。药品批发企业的严重缺陷项目：药品批发的质量管理有关检查项目共256项，含严重缺陷项目（**）10项，主要缺陷项目（*）103项，一般缺陷项目143项。其中，严重缺陷项目涉及**00201药品追溯管理与实施、**00401依法经营、**00402诚实守信（D对）、**03101质量管理体系文件“七要素”具备并符合企业实际、**04902储存疫苗配备2个以上独立冷库、**05805计算机系统软件与数据库、**06101购进合法性审核、**06601购进药品索取发票（C对）、**06701发票内容与付款流向等一致（B对）、**09101销售药品开具发票，并做到票账货款一致。药品零售企业的严重缺陷项目：药品零售的质量管理有关检查项目共176项，含严重缺陷项目（**）8项，主要缺陷项目（*）53项，一般缺陷项目115项。其中，严重缺陷项目涉及**00201药品追溯管理与实施、**00401依法经营、**00402诚实守信、**12101经营条件与经营范围规模相适应、**14504经营场所配备冷藏药品专用陈列设备、**14807仓库配备冷藏药品专用储存设备、**15209购进药品索取发票、**15211发票内容与付款流向等一致。